片剂的薄膜包衣材料通常由高分子成膜材料组成，并可添加增塑剂、致孔剂（释放调节剂）、着色剂与遮光剂等。常用的致孔剂是
A. 丙二醇
B. 醋酸纤维素酞酸酯
C. 醋酸纤维素
D. 蔗糖
E. 乙基纤维素

正确答案：D。蔗糖

解析：本题考查片剂的包衣。蔗糖（D对）是片剂薄膜包衣材料中的致孔剂；丙二醇（A错）为增塑剂；醋酸纤维素酞酸酯（B错）为肠溶性高分子包衣材料；醋酸纤维素（C错）、乙基纤维素（E错）均为水不溶性高分子薄膜包衣材料。